除特殊需要外，第一类精神药品的处方，每次不得超过多少日的常用量
A. 1日
B. 3日
C. 5日
D. 7日
E. 14日

正确答案：B。3日

解析：除特殊需要外，第一类精神药品的处方，每次不得超过多少日的常用量3日（B对）。